某女，41岁。近日因家事而情志抑郁，乳房胀痛，胃胀痞满，嗳气频作，月经延后；舌淡红，苔白，脉弦。根据藏象理论，其病机是
A. 心主血脉功能失常
B. 肝主疏泄功能失常
C. 脾主运化功能失常
D. 肺主气功能失常
E. 肾藏精功能失常

正确答案：B。肝主疏泄功能失常

解析：本题考查的是肝的生理功能。某女，41岁。近日因家事而情志抑郁，乳房胀痛，胃胀痞满，嗳气频作，月经延后；舌淡红，苔白，脉弦。根据藏象理论，其病机是肝主疏泄功能失常（B对）。肝主疏泄，调畅全身气机功能，具体体现在五个方面：（1）调畅情志，肝的疏泄功能障碍，气机失于调畅，则会导致精神情志活动的异常，例如，易于抑郁、善怒等。（2）协调脾胃升降，若肝疏泄功能失常，既可影响脾气升清，致脾失健运、清气下陷，见腹胀、腹泻等症；又可影响胃气降浊，致胃失通降、胃气上逆，见纳呆、脘胀、嗳气、呕吐、便秘等。（3）促进胆汁生成与排泄，若肝气郁结，疏泄失职，胆汁的分泌排泄障碍，不仅会影响消化吸收功能，致厌油腻、腹胀；而且会导致胆汁郁积，进而形成结石，见胁痛、黄疸等症。（4）促进血液运行和津液代谢，若肝气疏泄失常，在气机失调的同时，可见血行异常，或津液代谢障碍。（5）调畅排精行经，若肝气郁结，疏泄失职，可导致男子精液排泄异常，或女子月经不调。心主血脉功能失常（A错）心主血脉（1）心有推动血液在脉管内运行的作用。例如，心的气、血、阴、阳不足或失调，皆可影响心脏的正常搏动而出现异常现象。（2）心对血液的生成也有一定的作用。例如，心血不足，可见心悸、脉数等症。脾主运化功能失常（C错）脾主运化（1）运化水谷精微，脾气的运化功能正常，称为“脾气健运”减退；其失常，称为“脾失健运”，则可影响饮食物的消化和精微的吸收而出现腹胀、便溏、食欲不振，乃至倦怠、消瘦等精气血生化不足的病变。脾气虚弱，不能升清，水谷精微无以上荣，可致头晕目眩等；升举无力，中气下陷，可致内脏下垂等症状。（2）运化水液，脾失健运，或津液生成不足，或津液输布障碍，而见水湿痰饮等。肺主气功能失常（D错）肺主气，司呼吸（1）肺主呼吸之气。（2）肺主一身之气。肾藏精功能失常（E错）肾藏精，主生长、发育与生殖（1）肾主生长、发育。（2）肾主生殖。（3）肾中阴阳为各脏阴阳之根本。